在污染源常年或季节主导风向比较明确时，大气监测采样点的选择应采用
A. 扇形布点
B. 梅花布点
C. 四周布点
D. 方格布点
E. 捕捉烟波布点

正确答案：A。扇形布点

解析：本题考查大气监测采样点的选择。在污染源常年或季节主导风向比较明确时，大气监测采样点的选择应采用扇形布点（A对BCDE错）。